诊断慢性支气管炎的标准是咳嗽、咳痰伴喘息，每年发作
A. 持续3个月、连续1年以上
B. 持续3个月、连续2年以上
C. 持续2个月、连续1年以上
D. 持续2个月、连续2年以上
E. 持续2个月、连续3年以上

正确答案：B。持续3个月、连续2年以上

解析：慢性支气管炎简称慢支，是气管、支气管黏膜及其周围组织的慢性非特异性炎症。临床上以咳嗽、咳痰为主要症状，或有喘息，每年发病持续3个月或更长时间，连续2年或2年以上，并排除具有咳嗽、咳痰、喘息症状的其他疾病（B对）。